30岁，男性。驾车撞树受伤，伤后右髋关节疼痛剧烈不能活动。查体：患肢短缩，呈屈曲、内收、内旋畸形，应首先考虑的诊断是
A. 股骨颈骨折
B. 股骨干骨折
C. 髋关节后脱位
D. 髋关节前脱位
E. 坐骨神经损伤

正确答案：C。髋关节后脱位

解析：患者车祸后，右髋关节疼痛剧烈不能活动，查体可见患肢短缩、呈屈曲内收内旋畸形（提示可能为髋关节后脱位），结合患者的病史、临床表现和体查，该患者应首先考虑的诊断为髋关节后脱位（C对）。股骨颈骨折（A错）多发生于中老年人，患者主要表现为髋部疼痛、下肢活动受限，患肢外旋畸形。股骨干骨折（P662）（B错）多发生在外力直接作用后，患者伤处可见骨折特征性表现如反常活动、畸形等。髋关节前脱位（D错）的典型临床表现为患肢外展、外旋及屈曲畸形。坐骨神经损伤（P701）（E错）高位损伤主要表现为膝关节不能屈、足下垂及小腿后外侧和足部感觉障碍。